为达到审美要求，可选择以下方式除了
A. 适当磨除基牙近缺隙侧斜面
B. 将桥体与邻牙重叠
C. 改变桥体的（牙合）面形态
D. 将桥体适当扭转
E. 改变颊嵴的位置

正确答案：C。改变桥体的（牙合）面形态

解析：正常桥体的（牙合）面形态改变不会影响美观。桥体的排列位置通常和缺失牙间隙一致，排列出的桥体形态与同名牙相似，与邻牙协调，达到美观的要求。如果缺牙区间隙过宽或过窄，可以采取相应的措施。当缺牙区间隙略大于同名牙时，可通过扩大唇面近远中邻间隙，加大桥体唇面突度，制作轴向发育沟纹等措施，利用视角误差达到改善美观的目的。如果缺牙间隙明显大于同名牙，可酌情添加一较小的人工牙。如果上颌第二前磨牙缺失而缺牙间隙较大，可将桥体颊面的颊嵴向近中移动，使近中面至颊嵴的宽度与第一前磨牙的相对应的宽度相等。当缺牙间隙小于同名牙时，可适当多磨除缺牙区两端基牙的近缺隙面，加宽间隙；也可将桥体适当扭转或与邻牙重叠；或是减小桥体唇向突度，制作近远中向横沟纹，使桥体的大小和形态接近同名牙。如果第二前磨牙的缺隙小于同名牙，可将颊面颊嵴偏向远中，使颊嵴近中颊面的宽度与第一前磨牙相等，改善美观。掌握“固定桥的设计”知识点。